徐长卿的功效有
A. 活血
B. 通络
C. 止痒
D. 解蛇毒
E. 祛风止痛

正确答案：A、B、C、D、E。活血；通络；止痒；解蛇毒；祛风止痛

解析：本题考查徐长卿的功效。徐长卿的功效有活血（A对）、通络（B对）、止痒（C对）、解蛇毒（D对）、祛风止痛（E对）。徐长卿【功效】祛风止痛，活血通络，止痒，解蛇毒。